在产地加工过程中，不宜水洗处理的药材有
A. 细辛
B. 苦参
C. 木香
D. 防己
E. 薄荷

正确答案：A、C、E。细辛；木香；薄荷

解析：本题考查的是常用的产地加工方法。在产地加工过程中，不宜水洗处理的药材有细辛（A对）、木香（C对）与薄荷（E对）。拣、洗：将采收的新鲜药材除去泥沙杂质和非药用部分。但具芳香气味的药材一般不用水洗，如薄荷、细辛、木香等。鲜用药材洗后晾干，进行保鲜处理。苦参（B错）：【采收加工】春、秋二季采挖，除去根头及小支根，洗净，干燥，或趁鲜切片，干燥。防己（D错）：【采收加工】秋季采挖，洗净，除去粗皮，晒至半干，切段，个大者再纵切，干燥。